下列哪种情况不是放置引流的适应证
A. 可能发生感染的污染创口
B. 较浅小的无菌创口
C. 留有死腔的创口
D. 止血不全的创口
E. 脓肿切开的创口

正确答案：B。较浅小的无菌创口

解析：本题考查外科引流的适应证。较浅小的无菌创口（B错，为本题的正确答案）不是放置引流的适应证。外科引流的适应证：1.感染或污染创口（A对）：感染创口如脓肿切开等必须放置引流物，以使腔内脓液得以不断排出；切口有严重感染或手术本身属于污染创口，为防止感染，也应考虑放置引流；清洁创口，特别是单纯整复手术，一般不放置引流。2.渗液多的创口（E对）：对范围广泛的大手术及部位深在的中等手术，考虑其术后仍有部分渗血、渗液，应放置引流。3.留有死腔的创口（C对）：凡术中因组织缺损较大、未能完全消灭死腔的口内、口外创口，必须放置引流。其引流物需放置于死腔底部，才能保证彻底引流。4.止血不全的创口（D对）：对术中止血不彻底和凝血功能低下的患者，为防止血肿形成，也应放置引流。